《中国药典》规定，凡检查溶出度、释放度或分散均匀性的制剂，一般不再检查的项目是
A. 有关物质
B. 崩解时限
C. 残留溶剂
D. 重（装）量差异
E. 含量均匀度

正确答案：B。崩解时限

解析：本题考查崩解时限检查法。《中国药典》规定，凡检查溶出度、释放度或分散均匀性的制剂，一般不再检查的项目是崩解时限（B对）。崩解时限检查法：系用于检查口服固体制剂在规定条件下的崩解情况。崩解系指口服固体制剂在规定条件下全部崩解溶散或成碎粒，除不溶性包衣材料或破碎的胶囊壳外，应全部通过筛网。如有少量不能通过筛网，但已软化或轻质上漂且无硬心者，可作符合规定论。除另有规定外，凡规定检查溶出度、释放度或分散均匀性的制剂，不再进行崩解时限检查。凡检查含量均匀度的制剂，一般不再检查重（装）量差异（D错）；当全部主成分均进行含量均匀度检查时，复方制剂一般亦不再检查重（装）量差异。除另有规定外，片剂、硬胶囊剂、颗粒剂或散剂等，每一个单剂标示量小于25mg或主药含量小于每一个单剂重量25%者；药物间或药物与辅料间采用混粉工艺制成的注射用无菌粉末；内充非均相溶液的软胶囊；单剂量包装的口服混悬液、透皮贴剂和栓剂等品种项下规定含量均匀度应符合要求的制剂，均应检查含量均匀度。复方制剂仅检查符合上述条件的组分，多种维生素或微量元素一般不检查含量均匀度（E错）。残留溶剂（C错）应根据生产工艺中所用有机溶剂及其残留情况，确定检查项目。可参考《中国药典》关于残留溶剂的要求，或参考ICH文件Q3C（残留溶剂指导原则），对残留的毒性溶剂，应规定其检查项目。